女，60岁，牙床肿痛2周，1年前曾有过肿痛，但未治疗。检查：左下6颊侧牙龈肿胀，有一瘘管，瘘管指向根尖方向，其颊侧中央及远中、舌侧均有5～6mm的牙周袋。为明确诊断，应作的一项重要检查是
A. 探诊出血
B. 牙齿松动度
C. 拍摄X线片
D. 根分叉的探查
E. 探查龈下牙石

正确答案：C。拍摄X线片

解析：本题考查窦型慢性根尖周炎及牙周炎的检查。根据病例描述，牙床肿痛2周，左下6颊侧牙龈肿胀，颊侧中央及远中、舌侧均有5～6mm的牙周袋，可考虑患者有牙周炎，但需要拍摄X线片（C对）看是否有牙槽骨吸收，以确定诊断；瘘管指向根尖方向考虑患牙根尖有化脓性炎症，但也需要拍摄X线片观察根尖是否有骨质破坏，以确定是否有牙髓的逆行性感染。探诊出血（A错）主要是检查牙龈和牙周组织的炎症程度，起协助诊断作用。牙周炎晚期和急性根尖周炎时都会有牙齿松动度的改变，牙齿松动度（B错）的检查并不能确定诊断，只起协助诊断作用。根分叉病变为牙周炎的伴发病变，多出现在牙周炎病变晚期的时候，早期不会出现，根分叉的探查（D错）对早期牙周炎的诊断无意义。龈下牙石是牙龈炎牙周炎的刺激因素，对龈下牙石进行探查（E错），龈下牙石的多少并不能作为确诊牙周炎的依据，对于该病例的明确诊断意义不大。